对MRSA引起的肺炎，首选抗生素是
A. 青霉素G
B. 头孢唑啉
C. 苯唑西林
D. 万古霉素
E. 头孢呋辛

正确答案：D。万古霉素

解析：MRSA（耐甲氧西林金黄色葡萄球菌）属于耐药菌，首选万古霉素（D对）。青霉素G（A错）、苯唑西林（C错）、一代头孢（头孢唑啉）（B错）及二代头孢（头孢呋辛）（E错）对耐药菌均无效。